关于药物主动转运特点，错误的是
A. 无部位特异性
B. 逆浓度梯度转运
C. 需要消耗机体能量
D. 需要载体参与
E. 有结构特异性

正确答案：A。无部位特异性

解析：本题考查药物主动转运的特点。药物主动转运的特点包括：①逆浓度梯度转运（B对）；②需要消耗机体能量（C对）；③转运速度与载体量有关（D对）；④可与结构类似的物质发生竞争现象；⑤受抑制剂的影响；⑥具有结构特异性（E对）⑦主动转运还有部位特异性（A错，为本题正确答案）。